呈长纺锤形，外皮多已除去，表面黄白色至淡棕色，半透明，对光透视可见一细木心的中药材是
A. 白及
B. 半夏
C. 天冬
D. 银柴胡
E. 麦冬

正确答案：C。天冬